急性牙髓炎患牙可通过摘除全部或大部分牙髓，消除或减轻患牙疼痛，称为
A. 牙髓切断术
B. 牙髓摘除术
C. 根管治疗术
D. 根尖诱导成形术
E. 牙齿拔除术

正确答案：B。牙髓摘除术

解析：牙髓摘除术：急性牙髓炎患牙可通过摘除髓腔内全部或大部分牙髓，去除病变牙髓组织，消除或减轻患牙的疼痛。掌握“急症处理”知识点。